上颌牙槽嵴吸收的方向
A. 向下向内
B. 向下向外
C. 向上向内
D. 向上向外
E. 向上

正确答案：C。向上向内

解析：本题考查牙列缺失后的病因及影响。牙槽嵴吸收多少与骨质致密度直接有关，上颌牙槽嵴外侧骨板较内侧骨板疏松，外侧骨板吸收较内侧骨板多，牙槽嵴吸收的方向为向上向内（C对）。